依照《处方管理办法》的规定，麻醉药品的门(急)诊处方剂量，每张处方注射剂不得超过
A. 1次常用量
B. 2日常用量
C. 3日常用量
D. 7日常用量
E. 15日常用量

正确答案：A。1次常用量

解析：依照《处方管理办法》的规定，麻醉药品的门(急)诊处方剂量，每张处方注射剂不得超过1次常用量（A对）；控缓释制剂，每张处方不得超过7日常用量（D错）；其他剂型，每张处方不得超过3日常用量（C错）。